瓜蒌的主治病证有
A. 肺热咳嗽
B. 胸痹作痛
C. 肠燥便秘
D. 肺虚久咳
E. 疮痈瘰疬

正确答案：A、B、C。肺热咳嗽；胸痹作痛；肠燥便秘

解析：本题考查的是瓜蒌的主治病证。瓜蒌的主治病证有肺热咳嗽（A对）、胸痹作痛（B对）与肠燥便秘（C对）。瓜蒌：【主治病证】（1）肺热咳嗽、痰稠不易咳出。（2）胸痹，结胸。（3）乳痈肿痛，肺痈，肠痈。（4）肠燥便秘。川贝母：【主治病证】（1）肺热咳喘，外感咳嗽。（2）肺燥咳嗽，肺虚久咳（D错），阴虚劳嗽。（3）痰热或火郁胸闷，瘰疬，疮肿，乳痈，肺痈（E错）。